在慢性病中，医患关系中最理想的模式是
A. 主动被动型
B. 共同参与型
C. 指导合作型
D. 主动主动型
E. 被动被动型

正确答案：B。共同参与型

解析：医患关系模式有三种基本类型：主动-被动型、指导-合作型、共同参与型（DE错）。共同参与型（B对）指医患双方共同制定并实施诊断方案，适合长期慢性疾病病人和心理疾病病人。主动被动型（A错）指医师主动命令，病人被动服从，适合难以表述自己主观意见的病人，如麻醉、严重外伤昏迷的病人等。指导合作型（C错）是指在医疗活动中，医患双方具有一定的主动性，但仍以医务人员为主，适合于急性感染期病人。